进行独立样本t检验除正态性外，还要求数据应满足的是
A. 独立性和均衡性
B. 均衡性和随机性
C. 方差齐性和独立性
D. 独立性和随机性
E. 方差齐性和随机性

正确答案：C。方差齐性和独立性